与食品营养价值无关的是
A. 营养素的种类
B. 营养素的数量
C. 营养素间的相互比例
D. 消化、吸收和利用率
E. 食品的来源

正确答案：E。食品的来源